男性患者56岁，有急性心肌梗死病史，经治疗好转后，停药月余，昨夜突发剧咳而憋醒，不能平卧，咳粉红色泡沫样痰，烦躁不安，心率130次/分，血压21.3～12.6kPa，两肺有小水泡音。诊断为急性左心衰竭，心源性哮喘，问用哪组药物治疗最适宜
A. 氢氯噻嗪+地高辛
B. 吗啡+毒毛花苷K
C. 氢氯噻嗪+硝普钠
D. 氢氯噻嗪+卡托普利
E. 氢氯噻嗪+氨茶碱

正确答案：B。吗啡+毒毛花苷K

解析：患者为急性心梗后1月余后出现急性左心衰。吗啡是治疗急性肺水肿极为有效的药物。①抑制中枢性交感神经而反射性降低外周静脉和小动脉张力，减轻心脏前后负荷。②降低呼吸中枢兴奋性，使呼吸频率减慢，呼吸深度变小，松弛支气管平滑肌，改善通气功能。③中枢性镇静作用可减轻病人烦躁不安而减低耗氧。急性心肌梗死避免在发病24小时内应用强心苷。患者为急性心梗后1月余且没有合并快速房颤，故可用强心苷。掌握“吗啡、哌替啶”知识点。